结构中含有硒蛋白的酶是
A. 谷氨酰胺转肽酶
B. 碱性磷酸酶
C. 谷胱甘肽过氧化物酶
D. 丙酮酸氧化酶
E. 胆碱酯酶

正确答案：C。谷胱甘肽过氧化物酶

解析：本题考查结构中含有硒蛋白的酶。硒在生物体内以硒蛋白的形式构成谷胱甘肽过氧化物酶（C对ABDE错）的活性中心，能有效地清除机体产生的自由基和脂质过氧化物，阻断其对生物膜和生物大分子的损害。